表观分布容积的“表观”二字的解释应该是
A. 表现出来供观赏的
B. 表达其观察结果的
C. 表明其实际情况的
D. 表示观察实际数据的
E. 实际上是不存在的

正确答案：E。实际上是不存在的